28岁已婚妇女，停经50日突觉右下腹剧痛伴休克；面色苍白。为确诊最简便、有效的辅助诊断方法是
A. 阴道后穹窿穿刺
B. 尿妊娠试验
C. 阴道镜检查
D. 宫腔镜检查
E. 腹腔镜检查

正确答案：A。阴道后穹窿穿刺

解析：育龄期妇女，停经50日（输卵管妊娠多有6～8周停经史），突觉右下腹剧痛（输卵管妊娠典型的症状为停经后腹痛与阴道流血，输卵管妊娠流产或破裂时突感一侧下腹部撕裂样疼痛），伴休克，面色苍白（当腹腔出血较多时，可出现面色苍白、脉搏快而细弱、心率增快和血压下降等休克表现），首先考虑输卵管妊娠破裂伴腹腔内出血，确诊最简便有效的辅助诊断方法是阴道后穹窿穿刺（A对）。阴道后穹窿穿刺是一种简单可靠的诊断方法，适用于疑有腹腔内出血的患者。尿妊娠试验即hCG测定（B错）主要用于早早孕诊断。阴道镜检查（C错）主要用于阴道和宫颈病变者。宫腔镜检查（D错）主要用于宫腔内病变者。腹腔镜检查（P54）（E错）有漏诊情况，已经不是异位妊娠的“金标准”。